下列哪几点与维生素D类相符
A. 都是甾醇衍生物
B. 其主要成员是D₂， D₃
C. 是水溶性维生素
D. 临床主要用于抗佝偻病
E. 不能口服

正确答案：A、B、D。都是甾醇衍生物；其主要成员是D₂， D₃；临床主要用于抗佝偻病

解析：本题考查维生素D。维生素D属于脂溶性维生素（C错），是一种类固醇激素（A对）。维生素D家族成员中最重要的成员是VD₂（麦角钙化醇）和VD₃（胆钙化醇）（B对）。维生素D缺乏时人体吸收钙、磷能力下降，钙、磷不能在骨组织均匀沉积，成骨作用受阻，故维生素D可用于抗佝偻病（D对）。临床上使用的是维生素D的口服制剂（E错）。